在一个常规的统计表内，非必需包括的内容是
A. 标题
B. 标目
C. 线条
D. 数字
E. 备注

正确答案：E。备注